含苯甲酸酯结构的局部麻醉药有
A. 盐酸丁卡因
B. 盐酸布比卡因
C. 盐酸普鲁卡因
D. 盐酸利多卡因
E. 盐酸罗哌卡因

正确答案：A、C。盐酸丁卡因；盐酸普鲁卡因